以下关于手-足-口病的叙述错误的是
A. 感染柯萨奇病毒A16或EV71型所引起
B. 口腔损害比皮肤重
C. 口腔损害广泛分布于唇、颊、舌、腭等处
D. 迅速成为溃疡
E. 经10～14日后愈合

正确答案：E。经10～14日后愈合

解析：手-足-口病：是因感染柯萨奇病毒A16或EV71型所引起的皮肤黏膜病。但口腔损害比皮肤重。前驱症状有发热、困倦与局部淋巴结肿大，然后在口腔黏膜、手掌、足底出现散在水疱、丘疹与斑疹，数量不等。斑疹周围有红晕，无明显压痛，其中央为小水疱，皮肤的水疱数日后干燥结痂。口腔损害广泛分布于唇、颊、舌、腭等处，初起时多小水疱，迅速成为溃疡，经5～10日后愈合。掌握“手-足-口病”知识点。